根据《药品注册管理办法》，药品批准文号为“国药准字H20070272”的药品属于
A. 生物制品
B. 中成药
C. 化学药品
D. 进口药品
E. 中药饮片

正确答案：C。化学药品

解析：本题考查的是药品批准文号的格式。根据《药品注册管理办法》，药品批准文号为“国药准字H20070272”的药品属于生物制品（A对）。药品注册证书载明的药品批准文号的格式：①境内生产药品：国药准字H（Z、S）+四位年号+四位顺序号；②中国香港、澳门和台湾地区生产药品：国药准字H（Z、S）C+四位年号+四位顺序号；③境外生产药品（D错）：国药准字H（Z、S）J+四位年号+四位顺序号。其中，H代表化学药（C错），Z代表中药（BE错），S代表生物制品。药品批准文号，不因上市后的注册事项的变更而改变。